不属于下消化道的器官是
A. 十二指肠
B. 空肠
C. 回肠
D. 盲肠
E. 结肠

正确答案：A。十二指肠

解析：从口腔到十二指肠(A错)均属于上消化道，不属于下消化道，空(B对)、回肠(C对)，盲肠(D对)和结肠(E对)都属于下消化道。